不是进行健康危险度评价的基本内容
A. 危害鉴定
B. 污染来源鉴定
C. 暴露评价
D. 剂量-反应关系评定
E. 危险度特征分析

正确答案：B。污染来源鉴定

解析：本题考查健康危险度评价的基本内容。健康危险度评价是按一定的准则，应用毒理学研究和流行病学调查等的资料，系统科学地表征有害环境因素暴露对人类和生态的潜在损害作用，并对产生这种损害作用证据的强度或充分性进行评定，对危险性评估相关的不确定性进行评价。其基本内容包括：1.危害鉴定（A对）：定性评价，主要分析流行病学和毒理学的研究资料；2.剂量-反应关系的评定（D对）：核心内容；3.暴露评价（C对）：关键步骤，确定暴露水平和暴露人群特征；4.危险度特征分析（E对）：综合分析。污染来源鉴定（B错，为本题正确答案）不是健康危险度评价的基本内容。